固定义齿中修复缺牙的部分称为
A. 冠内固位体
B. 冠外固位体
C. 固定连接体
D. 活动连接体
E. 桥体

正确答案：E。桥体

解析：本题考查固定局部义齿的组成。固定义齿中修复缺牙的部分称为桥体（E对）。固定局部义齿（固定桥）由固位体、桥体和连接体三部分组成。1.固位体是固定桥粘固或粘接于基牙上的构造，固定桥靠固位体与基牙连结在一起并将（牙合）力通过固位体传给基牙，应有良好的固位力与抗力。固位体一般分为三种类型，即冠外固位体（B错）、冠内固位体（A错）与根内周位体。2.桥体是固定桥的人工牙部分，制作固定桥的目的便是作出桥体，以恢复缺失牙的形态与功能。3.连接体是连接桥体与固位体的部分，因连接方式不同而分为固定连接体（C错）和活动连接体（D错）。